伴有严重焦虑症状的抑郁症患者，宜首先选用
A. 洛伐他汀
B. 氟西汀
C. 度洛西汀
D. 普伐他汀
E. 头孢西汀

正确答案：B。氟西汀

解析：本题考查抗焦虑药。氟西汀（B对）用于伴有严重焦虑症的抑郁患者，老年人初始一日10mg，需要时增至一日20～60mg。洛伐他汀（A错）主要用于治疗高胆固醇血症和混合型高脂血症。度洛西汀（C错）用于治疗成人严重抑郁症。普伐他汀（D错）用于饮食限制仍不能控制的原发性高胆固醇血症或合并有高甘油三酯血症患者。头孢西汀（E错）用于敏感菌所致的呼吸道感染、心内膜炎、尿路感染等。